肺通气/血流比值＞0.8的疾病是
A. 肺血栓栓塞
B. 肺气肿
C. 哮喘
D. 慢性支气管炎
E. 肺水肿

正确答案：A。肺血栓栓塞

解析：正常成人静息状态下，通气／血流比例约为0.8。肺栓塞，因部分肺泡血流不足，引起栓塞部位血流减少，通气／血流比例增大，肺泡通气不能被充分利用，又称为无效腔样通气（A对）；肺气肿时，肺弹性成分大破坏，肺回缩力减小，顺应性增大，弹性阻力减小，患者表现为呼气困难，这些情况都会导致肺通气功能降低，不会导致通气／血流比例增大（B错）；哮喘发作时，呈阻塞性通气功能障碍表现，用力肺活量正常或下降，第一秒用力呼气容积秒率以及最高呼气流量下降，残气量及残气与肺总量比值增加，不会导致通气／血流比例增大（C错）；慢性支气管炎，是气管、支气管黏膜及其周围组织的慢性非特异性炎症，呼吸功能早期无异常，当使用支气管扩张剂后第一秒用力呼气容积与用力肺活量比值<0. 70，不会导致通气／血流比例增大（D错）；肺水肿因部分肺泡通气不足，通气／血流比例变小（E错）。